脓肿溃破后有袋脓现象，经其它引流治疗后无效者，应选用
A. 挂线法
B. 结扎法
C. 砭镰法
D. 扩创引流
E. 浸渍法

正确答案：D。扩创引流

解析：扩创引流是应用手术的方法来进行引流，用于脓肿溃破后有袋脓现象，经其他引流、垫棉法等无效者（D对）。挂线法（A错）适于疮疡溃后脓水不净，经内服、外敷等治疗无效而形成瘘管或窦道者；或疮口过深或生于血络丛处而不宜采用切开手术者。结扎法（B错）适于瘤、赘疣、痔、脱疽等病，以及脉络断裂引起的出血之症。砭镰法（C错）适于急性阳证疮疡。浸渍法（E错）适于阳证疮疡初起和溃后、半阴半阳证及阴证疮疡。